骑跨伤易伤及
A. 球部尿道
B. 膜部尿道
C. 悬垂部尿道
D. 前列腺部尿道
E. 膀胱颈部

正确答案：A。球部尿道

解析：会阴部骑跨伤时，最易伤及前尿道，如尿道球部（A对）。膜部尿道（B错）、前列腺部尿道（D错）均属于后尿道，损伤多见于骨盆骨折。悬垂部尿道（C错）、膀胱颈部（E错）的损伤较少见。